促进胃排空的主要因素是
A. 大量食物入胃的机械和化学刺激
B. 十二指肠内的酸性刺激
C. 十二指肠内的脂肪增加
D. 十二指肠内渗透压增高
E. 食糜进入十二指肠的机械和化学刺激

正确答案：A。大量食物入胃的机械和化学刺激